下列有关Kennedy第四类的设计要点，说法不正确的是
A. 多数前牙缺失，直接固位体放在第一前磨牙以后的牙上
B. 黏膜支持式义齿，应适当扩大义齿的基托面积
C. 前牙为深覆（牙合）时，应设计塑料基托
D. 患者不愿显露金属卡环等情况下可设计为黏膜支持式义齿
E. 前部牙多数缺失，其设计要点同Kennedy第一类缺失

正确答案：C。前牙为深覆（牙合）时，应设计塑料基托

解析：Kennedy第四类的设计要点：缺牙间隙在牙弓的前端，余留天然牙在牙弓的远端，常设计为天然牙和黏膜混合支持式义齿。少数前牙缺失，余留牙咬合紧；或余留牙牙冠短，基牙颊面不能获得倒凹固位者；患者不愿显露金属卡环等情况下可设计为黏膜支持式义齿。设计要点如下：1）黏膜支持式义齿，应适当扩大义齿的基托面积，基托的上缘应与天然牙舌面的非倒凹区接触，以增强固位和防止食物嵌塞。但也不能过紧地挤压牙面，以免造成牙齿移位。2）多数前牙缺失，直接固位体放在第一前磨牙以后的牙齿上，以免影响美观。3）前部牙多数缺失，其设计要点同Kennedy第一类缺失，即在远中余留牙上设计间接固位体，以平衡、稳定义齿。4）前牙为深覆（牙合）时，应设计金属基托。掌握“局部义齿的设计”知识点。